链球菌感染后急性肾小球肾炎与膜增生性肾小球肾炎相鉴别的要点是
A. ASO是否升高
B. 有无前驱感染
C. 是否伴肾病综合征表现
D. 早期有无少尿、无尿及肾功能恶化
E. 低补体血症是否于8周内恢复

正确答案：E。低补体血症是否于8周内恢复

解析：链球菌感染后急性肾小球肾炎血清C3下降，于发病8周内逐渐减轻到完全恢复正常。系膜毛细血管性肾小球肾炎又称为膜增生性肾小球肾炎（MPGN），临床上除表现急性肾炎综合征外，经常伴肾病综合征，病变持续无自愈倾向。50%～70%患者有持续性低补体血症，8周内不恢复，此为与链球菌感染后急性肾小球肾炎鉴别要点（E对）。膜增生性肾小球肾炎约1/4～1/3患者常在上呼吸道感染后，表现为急性肾炎综合征，其致病菌可为链球菌。因此二者均可有前驱感染史，有无前驱感染（B错）不是二者的鉴别要点。ASO升高提示链球菌感染，二者均可升高，ASO是否升高（A错）不是该两者的鉴别要点。急性肾小球肾炎表现为急性肾炎综合征，膜增生性肾小球肾炎既可表现为急性肾炎综合征又可表现为肾病综合征，因此是否伴肾病综合征表现（C错）不是二者的鉴别要点。二者均不会早期有无少尿无尿及肾功能恶化（D错）。